氢氯噻嗪的作用机制是
A. 抑制远曲小管近端Na⁺–Cl⁻共转运子
B. 抑制血管紧张素转换酶活性
C. 增快心率
D. 阻滞Ca²⁺通道
E. 增强心肌收缩力

正确答案：A。抑制远曲小管近端Na⁺–Cl⁻共转运子

解析：氢氯噻嗪是噻嗪类利尿剂，其作用机制是抑制远曲小管近端Na⁺–Cl⁻共转运子（A对）。抑制血管紧张素转换酶活性（B错）是血管紧张素Ⅰ转换酶抑制剂（ACEI）（如卡托普利）的作用机制。 增快心率（C错）是肾上腺素（P81）等药物的作用机制。阻滞Ca²⁺通道（D错）是钙通道阻滞药（如维拉帕米）（P198）的作用机制。增强心肌收缩力（E错）是强心苷类药物（P235）、肾上腺素（P81）等的作用机制。